下列哪项不是雌激素减少所导致的
A. 促钙和磷沉积作用减弱
B. 促骨基质合成功能减弱
C. 拮抗甲状旁腺素作用减少
D. 降钙素分泌增加
E. 促进维生素D₃合成及小肠钙吸收作用减小

正确答案：D。降钙素分泌增加

解析：本题考查雌激素减少的相关内容。降钙素分泌增加（D错，为本题正确答案）可能是由于细菌、真菌感染或脓毒血症引起。雌激素减少会导致机体：（1）对心血管系统的影响：雌激素参与血浆胆固醇的代谢，具有促进胆固醇下降和排泄的作用，雌激素水平下降，降低血脂的功能随之减弱，不利于心血管的低密度脂蛋白及甘油三酯上升，导致动脉硬化，高血脂，容易发生冠心病和心肌梗死。（2）引起骨代谢的改变：骨是雌激素的受体器官，雌激素可直接调节骨代谢。更年期后雌激素减少能促钙和磷沉积作用减弱（A对），促骨基质合成功能减弱（B对），拮抗甲状旁腺素作用减少（C对），促进维生素D₃合成及小肠钙吸收作用减小（E对），导致骨质疏松。